为了提高诊断实验的阳性预测值，最有效的办法是
A. 提高该试验的特异度
B. 提高该试验的灵敏度
C. 正确选择病例
D. 正确选择对照
E. 采用双盲法

正确答案：A。提高该试验的特异度

解析：本题考查灵敏度、特异度对预测值的影响。当人群患病率不变时，灵敏度升高，特异度降低，则阳性预测值下降，阴性预测值升高。同理，筛检试验的灵敏度降低，特异度升高（A对BCDE错），则阳性预测值升高，阴性预测值降低。